患囊尾蚴病的原因是进食了
A. 裂头蚴
B. 猪带绦虫卵
C. 猪带绦虫幼虫
D. 牛带绦虫幼虫
E. 牛带绦虫卵

正确答案：B。猪带绦虫卵

解析：患囊尾蚴病的原因是进食了猪带绦虫卵（B对）。